女，30岁。初产妇，身高160cm。妊娠39周+1天，规律腹痛2小时。查体：足先露，胎膜未破，胎心138次/分，骨盆测量正常，宫口开大1cm，估计胎儿体重3950g。恰当的处理措施是
A. 人工破膜
B. 观察产程进展
C. 取胸膝卧位
D. 尽快剖宫产
E. 行外转胎位术

正确答案：D。尽快剖宫产

解析：初产妇，身高160cm，妊娠39周+1天（妊娠满37周至不满42足周为足月产），规律腹痛2小时（规律宫缩，临产标志）。查体：足先露（胎位异常，不完全臀先露），胎膜未破，胎心138次/分（正常值110-160次/分），骨盆测量正常，宫口开大1cm，估计胎儿体重3950g（＞3500g），产妇符合剖宫产手术指征，故恰当的处理措施是尽快剖宫产（D对）。人工破膜（P209）（A错）适用于宫缩乏力，为促进产程进展而采取的方法。所以观察产程进展（B错）是分娩进行过程中的处理，该产妇处于临产阶段，尚未进入产程。取胸膝卧位（C错）（P204）和行外传胎位术（E错）（P204）为妊娠期胎位矫正方法，而产妇现已临产。